根据药品生产监督管理的规定，药品生产监督管理包括的依法对药品生产条件和生产过程的管理活动是
A. 进行审查、许可、质量认证等管理活动
B. 进行审查、验收、许可、质量认证等管理活动
C. 进行审查、许可、检查等管理活动
D. 进行审查、许可、检验、认证等管理活动
E. 进行审查、验收、许可、检查等管理活动

正确答案：C。进行审查、许可、检查等管理活动